患者，女，55岁，关节痛半年，临床诊断为类风湿性关节炎，既往有十二指肠溃疡病史，应首选的NSAID的药物是
A. 塞来昔布
B. 吲哚美辛
C. 布洛芬
D. 双氯芬酸
E. 萘普生

正确答案：A。塞来昔布

解析：本题考查治疗类风湿性关节炎的药物。本题患者既有类风湿性关节炎及十二指肠溃疡，最适宜选择的药物为塞来昔布（A对）。选择性COX-2抑制剂（如昔布类）与非选择性的传统NSAIDs相比，能明显减少严重胃肠道不良反应。塞来昔布是选择性COX-2抑制剂，吲哚美辛（B错）、布洛芬（C错）、双氯芬酸（D错）和萘普生（E错）都属于非选择性的NSAIDs。